三角挺设计的主要依据是
A. 楔的原理
B. 杠杆原理
C. 轮轴原理
D. 切割力
E. 扭转力

正确答案：C。轮轴原理

解析：本题考查牙挺的工作原理。三角挺设计的主要依据是轮轴原理（C对）。三角挺的设计主要依据是轮轴原理。根挺及根尖挺主要使用的是轮轴原理、楔的原理及杠杆原理组合性动作（AB错），以达到高效、低创伤的效果。切割力一般用于多根牙的分牙拔除，可缩短时间，减少创伤（D错）。患牙脱位时使用扭转力（E错）、摇动力和牵引力。